中药糖浆剂的配制方法有
A. 混合法
B. 分散法
C. 热溶法
D. 稀释法
E. 冷溶法

正确答案：A、C、E。混合法；热溶法；冷溶法